世界上最早进行死骨剔除术和解剖术的外科医家
A. 扁鹊
B. 郑玄
C. 华佗
D. 医竘
E. 张仲景

正确答案：C。华佗

解析：华佗是我国历史上最著名的外科医生，他发明麻沸散作为全身麻醉剂，进行死骨剔除术、剖腹术（C对）。扁鹊，战国时期医学家，善于运用问闻望切四诊，被尊为医祖（A错）。郑玄，东汉末年的经学大师，他遍注儒家经典，以毕生精力整理古代文化遗产，使经学进入了一个小统一时代（B错）。医竘，春秋时期秦国名医。甚精于外科，适有张子求疗背疾，竘以外科手术疗之而愈。竘曾为宣王割痤，为惠王疗痔，皆获愈，反映当时之外科水平（D错）。汉代张仲景，其《伤寒杂病论》对中医外科的贡献较大。书中提出的辨证论治理论，对外疾科病的证治同样具有重要的指导意义（E错）。